帕金森病的中枢变性部位在
A. 小脑齿状核
B. 脑桥基底部
C. 壳核
D. 丘脑
E. 黑质纹状体

正确答案：E。黑质纹状体